分布到乳头平面的胸神经为
A. T4
B. T6
C. T8
D. T10
E. T12

正确答案：A。T4

解析：T4（A对）相当于乳头平面。T6（B错）相当于剑突平面。T8（C错）相当于两侧肋弓中点连线的平面。T10（D错）相当于脐平面。T12（E错）相当于脐与耻骨联合连线中点的平面。